切牙切端舌侧长条形的釉质隆起，称为
A. 边缘嵴
B. 切嵴
C. 牙尖嵴
D. 三角嵴
E. 斜嵴

正确答案：B。切嵴

解析：切嵴：是切牙切端舌侧长条形的釉质隆起，具有切割功能。掌握“牙的萌出、更替及牙体解剖名词、标志”知识点。